属于《疫苗流通和预防接种管理条例》规定的预防接种异常反应情形是
A. 心理因素发生的群体心因性反应
B. 实施规范接种后造成受种者的损害
C. 与受种者疾病偶合出现的损害
D. 疫苗质量不合格给受种者造成的损害
E. 接种医生违反接种程序造成的损害

正确答案：B。实施规范接种后造成受种者的损害

解析：预防接种异常反应，是指合格的疫苗在实施规范接种过程中或者实施规范接种后造成受种者的损害（B对），相关各方均无过错的药品不良反应。国务院《疫苗流通和预防接种管理条例》，不属于预防接种异常反应的情形包括：①因疫苗本身特性引起的接种后一般反应；②因疫苗质量不合格给受种者造成的损害（D错）；③因接种单位违反预防接种工作规范（E错）、免疫程序、疫苗使用指导原则、接种方案给受种者造成的损害；④受种者在接种时正处于某种疾病的潜伏期或者前驱期，与受种者疾病偶合出现的损害（C错）；⑤受种者有疫苗说明书规定的接种禁忌，在接种前受种者或者其监护人未如实提供受种者的健康状况和接种禁忌等情况，接种后受种者原有疾病急性复发或者病情加重；⑥因心理因素发生的群体心因性反应（A错）（P64）。